患者，男性，56岁。糖尿病患者，用胰岛素治疗，晚10时突起心慌、多汗、虚弱，继而神志不清。查：脉搏120次/分，尿糖（﹣），尿酮体（﹣）。尿素氮10.0mmol/L，最可能为
A. 高渗性昏迷
B. 低血糖昏迷
C. 酮症酸中毒昏迷
D. 脑血管意外
E. 尿毒症昏迷

正确答案：B。低血糖昏迷